不属于健康教育领域内的行为矫正技术有
A. 脱敏法
B. 示范法
C. 厌恶法
D. 强化法
E. 淡化法

正确答案：E。淡化法